某研究用甲、乙两种方法同时测量某市9处水源中氟含量（mg/L），采用Wilcoxon符号秩和检验比较两种方法的测量结果是否不同。如果甲、乙两种方法测量值之差中有0.02、﹣0.02，其绝对值的位次是3、4，则这两个差值的秩次分别为（秩次前面的“+”“﹣”号仅代表值的正负）
A. 3.5，﹣3.5
B. ﹣3.5，﹣3.5
C. 3.5，3.5
D. 3，﹣4
E. ﹣3，4

正确答案：A。3.5，﹣3.5